下列表述错误的是
A. 初乳富含免疫物质
B. 母乳中含铁量很低
C. 过渡乳中的乳糖和脂肪含量逐渐增多
D. 过渡乳中的蛋白质大量增加
E. 第2周以后分泌的乳汁为成熟乳

正确答案：D。过渡乳中的蛋白质大量增加